药品管理法规定实行品种保护制度的是
A. 新药
B. 首次在中国销售的药品
C. 非处方药
D. 医疗机构配制的制剂
E. 中药

正确答案：E。中药

解析：本题考查中药品种保护的目的和意义。药品管理法规定实行品种保护制度的是中药（E对）。中药品种保护的目的和意义：根据《中药品种保护条例》，实施中药品种保护的目的是提高中药品种的质量，保护中药生产企业的合法权益、促进中药事业的发展。中药品种保护制度的实施，促进了中药质量和信誉的提升，起到了保护先进、促进老药再提高的作用；保护了中药生产企业的合法权益，使一批传统名贵中成药和创新中药免除了被低水平仿制，调动了企业研究开发中药新药的积极性；维护了正常的生产秩序，促进了中药产业的集约化、规模化和规范化生产，促进了中药名牌产品的形成和科技进步。